黄曲霉毒素主要污染的食物是
A. 肉类食品
B. 蔬菜和水果
C. 粮油及其制品
D. 乳类及其制品
E. 腌制食品

正确答案：C。粮油及其制品